甲状舌管囊肿穿刺检查可抽出
A. 血性液体
B. 淋巴液
C. 胆固醇晶体
D. 草绿色液体
E. 微混浊的黄色稀薄或黏稠性液体

正确答案：E。微混浊的黄色稀薄或黏稠性液体

解析：甲状舌管囊肿有时穿刺检查可抽出透明、微混浊的黄色稀薄或黏稠性液体。掌握“甲状舌管囊肿及鳃裂囊肿”知识点。